用于治疗肺炎支原体引起的非典型性肺炎的药物是
A. 氯霉素
B. 青霉素
C. 替莫西林
D. 四环素
E. 利福平

正确答案：D。四环素

解析：本题考查四环素。用于治疗肺炎支原体引起的非典型性肺炎的药物是四环素（D对）。氯霉素（A错）是敏感菌株所致伤寒、副伤寒的首选药物。青霉素（B错）用于溶血性链球菌、肺炎链球菌、对青霉素敏感（不产青霉素酶）金葡菌等革兰阳性球菌所致的感染以及破伤风、气性坏疽、流行性脑脊髓膜炎、鼠咬热、梅毒、淋病。替莫西林（C错）对革兰阴性菌有高度抗菌活性，对β-内酰胺酶高度稳定，某些第三代头孢菌素耐药的革兰阴性菌应用本品有效。利福平（E错）对结核分枝杆菌和部分非结核分枝杆菌（包括麻风分枝杆菌等）在宿主细胞内外均有明显的杀菌作用。